乙烯基手套常在什么情况下使用
A. 手术
B. 检查
C. 手部过敏
D. 清洗器械
E. 风疹

正确答案：C。手部过敏

解析：本题考查医务人员个人防护用品-手套。乙烯基手套常在手部过敏（C对）时使用。在所有可能接触患者血液、唾液、黏膜的检查与治疗过程、所有接触使用过的器械过程、所有接触患者身体组织的过程中，口腔医务人员都要配戴手套。手套是一次性使用的，使用后作为医疗废物丢弃。用于口腔科的手套主要有乳胶手套、乙烯基手套以及外科消毒手套。（1）乳胶手套：主要用于检查、常规充填手术、修复、根管治疗、洁牙、照片、技工室等工作。当术者皮肤有破损，或患者有特殊感染问题时可使用双层手套以增强安全性，但灵巧性会受到一定影响。过去乳胶手套通常带有滑石粉，目前美国疾病预防和控制中心（CDC）建议使用不带滑石粉的乳胶手套。因长时间接触滑石粉可伤害手部皮肤，且滑石粉可以引起一些个体严重的过敏反应。（2）乙烯基手套：有些医护人员可能对乳胶有严重的过敏反应，这种“乳胶过敏症”是一种接触性皮炎。一直以来，推荐乳胶手套过敏者使用乙烯基手套，但据最新研究报道乙烯基手套的屏障作用时间只有5～10分钟，不可作为口腔科检查与治疗用途。目前，建议过敏者使用腈制品手套。（3）外科消毒手套：消毒无菌手套，当操作中需要接触大量血液或唾液（如外科手术、种植手术、牙周手术）时使用。